造成阑尾管腔阻塞从而诱发急性阑尾炎的最常见原因是
A. 阑尾肿瘤压迫
B. 食物残渣进入阑尾管腔
C. 阑尾壁淋巴滤泡增生
D. 蛔虫进入阑尾管腔
E. 粪石阻塞管腔

正确答案：C。阑尾壁淋巴滤泡增生

解析：阑尾管腔阻塞是急性阑尾炎最常见的病因，且造成阑尾官腔阻塞的最常见的原因是阑尾壁淋巴滤泡增生（C对）。阑尾肿瘤压迫（A错）、食物残渣进入阑尾管腔（B错）、蛔虫进入阑尾管腔（D错）、粪石阻塞管腔（E错）则是较少见的病因。